急性早幼粒细胞白血病（M3）首选的治疗是
A. 应用全反式维A酸
B. 应用干扰素–α
C. 放射治疗
D. 造血干细胞移植
E. 应用羟基脲

正确答案：A。应用全反式维A酸

解析：急性早幼粒细胞白血病（M₃）首选的治疗是全反式维A酸（A对）。干扰素-α（P578）（B错）、羟基脲（P579）（E错）主要用于慢性粒细胞白血病的治疗；放射治疗（P575）（C错）对白血病疗效差，仅用于中枢神经系统白血病的防治；造血干细胞移植（P579）（D错）是唯一可治愈白血病的方法，但常用于缓解后治疗，不是首选治疗。